某高校在某年秋季发生甲肝流行，描述这次暴发严重性的常用最佳指标是
A. 罹患率
B. 发病率
C. 患病率
D. 死亡率
E. 病死率

正确答案：A。罹患率